患者精神恍惚，心神不宁，悲忧善哭，时时欠伸，舌淡苔薄白，脉弦细。其治法是
A. 益气养血
B. 补肾宁心
C. 养心安神
D. 解郁化痰
E. 疏肝解郁

正确答案：C。养心安神

解析：根据“精神恍惚，心神不宁”可知病为“郁证”；根据“悲忧善哭，时时欠伸，舌淡苔薄白，脉弦细”可辨为“心神失养证”，其机理为情志过极伤于心，致心失所养，神失所藏，心神失常，治疗应养心安神（C对）。